属于二氢吡啶类的药物是
A. 普尼拉明
B. 加洛帕米
C. 哌克昔林
D. 维拉帕米
E. 硝苯地平

正确答案：E。硝苯地平